贫血患者应注意增加哪些食物的摄入
A. 蔬菜、水果
B. 粮谷类
C. 蛋类
D. 奶类
E. 动物内脏

正确答案：E。动物内脏